成人内服马钱子的一日用量是
A. 0.3～0.6g
B. 1～2g
C. 2～5g
D. 5～9g
E. 9～15g

正确答案：A。0.3～0.6g

解析：本题考查的是马钱子的用量用法。成人内服马钱子的一日用量是0.3～0.6g（A对）。马钱子：【用法用量】内服：炮制后入丸散，0.3～0.6g。外用：适量，研末调敷。肉桂：【用法用量】内服：煎汤，2～5g（C错），后下；研末，每次1～2g（B错）；或入丸散。采自粗枝条或幼树干皮者称官桂，作用较弱，用量可适当增加。天南星：【用法用量】内服：煎汤，5～9g（D错）；或入丸散。外用：适量，以生品研末调敷。内服燥湿化痰、祛风止痉宜制用，外用散结消肿宜生用。芡实：【用法用量】内服：煎汤，9～15g（E错）；或入丸散。